患者，女，30岁，小便灼热刺痛，尿色如洗肉水色，少腹拘急满痛。舌红苔黄，脉滑数。治疗应首选
A. 程氏萆薢分清饮
B. 知柏地黄丸
C. 小蓟饮子
D. 八正散
E. 沉香散

正确答案：C。小蓟饮子

解析：患者湿热下注膀胱，热盛伤络，迫血妄行，故见小便灼热刺痛，尿色如洗肉水色；血块阻塞尿路，故见少腹拘急满痛；舌红苔黄，脉滑数，均为血淋实证之征，治疗当清热利湿，凉血止血，方药选用小蓟饮子加减（C对）。程氏萆薢分清饮（A错）清热利湿，分清泄浊，治疗膏淋。知柏地黄丸（B错）滋补肾阴，清热止血，用于治疗血淋虚证。八正散（D错）清热利湿通淋，用于治疗热淋。沉香散（E错）理气疏导，通淋利尿，用于治疗气淋实证。